甘草的别名为
A. 南豆根
B. 冰台
C. 坤草
D. 国老
E. 海南子

正确答案：D。国老

解析：本题考查的是常见的饮片正名与相关别名。甘草的别名为国老（D对）。甘草别名：粉甘草、皮草、国老。南豆根（A错）为山豆根的别名。山豆根别名：广豆根、南豆根。冰台（B错）为艾叶的别名。艾叶别名：祁艾、蕲艾、炙草、冰台。坤草（C错）为益母草的别名。益母草别名：坤草、茺蔚、益明。海南子（E错）为槟榔的别名。槟榔别名：花槟榔、大腹子、海南子。